具有阿片样作用，长期大剂量服用产生欣快感的止泻药是
A. 双八面体蒙脱石散
B. 洛哌丁胺
C. 地衣芽孢活杆菌胶囊
D. 阿托品
E. 地芬诺酯

正确答案：E。地芬诺酯

解析：本题考查地芬诺脂。地芬诺醋（E对）具有阿片样作用，长期大量服用可产生欣快感，并可能出现药物依赖性。但常用量短期治疗，则产生依赖性的可能很小，与阿托品（D错）合用，可减少依赖性倾向。双八面体蒙脱石散（A错）适用于急、慢性腹泻；洛哌丁胺（B错）适用于急性腹泻以及各种病因引起的慢性腹泻，对胃、肠部分切除术后和甲亢引起的腹泻也有较好疗效；地衣芽孢活杆菌胶囊（C错）主要用于细菌或真菌引起的急、慢性肠炎、腹泻。